分布于胃底的动脉主要为
A. 胃左动脉
B. 胃右动脉
C. 胃网膜左动脉
D. 胃网膜右动脉
E. 胃短动脉

正确答案：E。胃短动脉

解析：胃短动脉（E对）、胃后动脉分布于胃底。其中胃短动脉经胃脾韧带至胃底，胃后动脉经胃膈韧带至胃底。